充填术后出现冷热痛一般为
A. 制洞中产热过多
B. 无基底或基底不全
C. 充填物折裂
D. 以上都可以

正确答案：D。以上都可以

解析：本题考查充填后疼痛。制洞中连续钻磨产热过多可激惹牙髓，导致牙髓充血，出现激发痛（A对）。无基底或基底不全，充填材料可传导冷、热刺激至牙髓，出现激发痛（B对）。充填物折裂，冷热刺激可从裂缝进入窝洞，刺激牙髓，出现冷热痛（C对）。（ABC均对，故D为本题的正确答案）。